滴虫性阴道炎主要的传播途径是
A. 性传播
B. 血液传播
C. 母婴传播
D. 吸毒传播
E. 呼吸道传播

正确答案：A。性传播

解析：滴虫性阴道炎的传播方式：1. 经性交直接传播（A对）是主要的传播方式 2. 间接传播：经公共浴池、浴盆、浴巾、游泳池、坐式便器、衣物、污染的器械或及敷料（医源性）等传播。血液传播（B错）、母婴传播（C错）、吸毒传播（D错）及呼吸道传播（E错）不是滴虫性阴道炎的传播方式。